传染病防控中，不属于切断传播途径的是
A. 隔离病人
B. 呼吸道隔离
C. 治愈病人
D. 接触隔离
E. 消毒

正确答案：C。治愈病人

解析：切断传播途径包括隔离和消毒；治愈病人不属于切断传播途径（C错，为本题正确答案）。